眼内压的升高是临床诊断青光眼的指征之一，青光眼患者的眼内压约在2.9～5.6kPa范围，无青光眼者的眼内压约在1.9～3.5kPa范围内，若将诊断标准由眼内压＞2.9kPa升高到＞3.5kPa，则下述正确的是
A. 灵敏度升高
B. 特异度升高
C. 灵敏度和特异度均升高
D. 灵敏度和特异度均下降
E. 不确定，因为不知道患病率情况

正确答案：B。特异度升高

解析：本题考查特异度。青光眼患者的眼内压约2.9～5.6kPa范围，无青光眼者的眼内压约在1.9～3.5kPa范围内，若将诊断标准由眼内压﹥2.9kPa升高到3.5kPa，则无青光眼的患者则被更高概率的鉴别开来，提高了特异度（B对ACDE错）。